患儿，75天。症见肤目发黄，颜色较深，暗晦无华，日渐加重，胁下痞块，纳呆易吐，大便溏、色灰白，舌紫黯，苔白。治疗首选方
A. 膈下逐瘀汤
B. 血府逐瘀汤
C. 少腹逐瘀汤
D. 桃红四物汤
E. 复元活血汤

正确答案：B。血府逐瘀汤

解析：该题主要考查胎黄的辩证以及方药的掌握。胎黄以婴儿出生后皮肤面目出现黄疽为特征，因与胎禀因素有关，故称“胎黄”或“胎疸”。气滞血瘀证病程较长，逐渐加重，属于阴黄证。除皮肤黄疽色泽晦暗无华外，还具有有形瘀积的重要病理变化和临床表现。该患儿，75天。症见肤目发黄，颜色较深，暗晦无华，日渐加重，胁下痞块，纳呆易吐，大便溏、色灰白，舌紫黯，苔白。可诊断为胎黄气滞血瘀证，治法化瘀消积。方药血府逐瘀汤加减（B对）。膈下逐瘀汤，治膈下瘀阻气滞，形成痞块，痛处不移，卧则腹坠，肾泻久泻（A错）。少腹逐瘀汤主治少腹积块（C错）。桃红四物汤主治妇女月经不调，非儿科用药（D错）。复元活血汤活血祛瘀，疏肝通络跌打损伤，瘀血阻滞证（E错）。